可以引起菌血症的细菌是
A. 肉毒梭菌
B. 霍乱弧菌
C. 白喉棒状杆菌
D. 破伤风梭菌
E. 伤寒沙门菌

正确答案：E。伤寒沙门菌

解析：伤寒沙门菌经口摄入后，侵入机体的细胞及组织，最终进入血液，引起菌血症（E对）；肉毒梭菌在厌氧环境下能产生毒性极强的肉毒毒素，所致疾病主要为毒素中毒，最常见的为肉毒中毒和婴儿肉毒病（A错）；霍乱弧菌主要在肠黏膜表面繁殖（B错），不侵入肠上皮细胞和肠腺，主要依靠霍乱肠菌素致病；白喉棒状杆菌侵入机体后仅在鼻腔、咽喉等局部生长繁殖，依靠其外毒素白喉毒素致病，细菌一般不入血（C错）；破伤风梭菌无侵袭力，仅在局部繁殖（D错），其产生的破伤风痉挛毒素，是目前已知的引起破伤风的主要致病物质。